光照患者左眼，左眼瞳孔对光反射存在，右眼瞳孔对光反射消失，病变在
A. 左视神经
B. 右视束
C. 右动眼神经
D. 右外侧膝状体
E. 右视神经

正确答案：C。右动眼神经

解析：瞳孔对光反射的通路为：视网膜→视神经→视交叉→视束→上丘臂→顶盖前区→两侧动眼神经副核→动眼神经→睫状神经节→节后纤维→瞳孔括约肌收缩→两侧瞳孔缩小。光照一侧眼时，光照刺激通过同侧眼的视神经传入，双侧眼的动眼神经传出，实现同侧眼的直接对光反射、对侧眼的间接对光反射。若光照患者左眼，左眼瞳孔对光反射存在，右眼瞳孔对光反射消失，证明病变在右动眼神经（C对）。左视神经（A错）受损时，左侧光照刺激传入中断，光照患者左眼时双眼瞳孔对光反射均消失。右视神经（E错）受损时，光照刺激通过左眼的传入传出正常，光照患者左眼时双眼瞳孔对光反射存在。右视束（B错）受损的结果与右视神经受损相同。因瞳孔对光反射通路不经过外侧膝状体，故右外侧膝状体（D错）受损时，光照患者左眼，双眼瞳孔对光反射存在。